治疗大多数品种的有机磷农药中毒采用
A. 胆碱酯酶复能剂
B. 阿托品
C. 对症治疗
D. 阿托品加对症治疗
E. 阿托品加胆碱酯酶复活药加对症治疗

正确答案：E。阿托品加胆碱酯酶复活药加对症治疗